根据《中华人民共和国中医药法》，需要同时依法取得《医疗机构制剂许可证》和制剂批准文号的情形是
A. 医疗机构仅应用传统工艺配制中药制剂品种的
B. 医疗机构委托取得《药品生产许可证》的药品生产企业配制中药制剂的
C. 医疗机构委托取得《医疗机构制剂许可证》其他医疗机构配制中药制剂的
D. 医疗机构应用现代工艺配制来源于古代经典名方的中药复方制剂的

正确答案：D。医疗机构应用现代工艺配制来源于古代经典名方的中药复方制剂的

解析：本题考查的是医疗机构制剂注册制度。根据《中华人民共和国中医药法》，需要同时依法取得《医疗机构制剂许可证》和制剂批准文号的情形是医疗机构应用现代工艺配制来源于古代经典名方的中药复方制剂的（D对）。医疗机构制剂注册制度：《药品管理法》规定，医疗机构配制的制剂，应当是本单位临床需要而市场上没有供应的品种，并应当经所在地省级药品监督管理部门批准；但是，法律对配制中药制剂另有规定的除外。《中医药法》规定，医疗机构配制中药制剂，应当依照《药品管理法》的规定取得医疗机构制剂许可证，或者委托取得药品生产许可证的药品生产企业、取得医疗机构制剂许可证的其他医疗机构配制中药制剂。委托配制中药制剂，应当向委托方所在地省、级药品监督管理部门备案（BC错）。医疗机构配制的中药制剂品种，应当依法取得制剂批准文号。但是，仅应用传统工艺配制的中药制剂品种，向医疗机构所在地省级药品监督管理部门备案后即可配制，不需要取得制剂批准文号（A错）。